长发被卷入机器中属于
A. 挫伤
B. 擦伤
C. 咬伤
D. 刺、割伤
E. 撕裂或撕脱伤

正确答案：E。撕裂或撕脱伤

解析：为较大的机械力将组织撕裂或撕脱，如长发被卷入机器中，可将大块头皮撕裂或撕脱，甚至整个头皮连同耳廓、眉毛及上眼睑同时撕脱。撕脱伤伤情重，出血多，疼痛剧烈，易发生休克。掌握“口腔颌面部软组织创伤”知识点。